细菌性食物中毒多见于夏秋季节，主要是由于
A. 气温较高，微生物易于生长繁殖
B. 进食熟肉类食品多
C. 人口流动性大
D. 夏季食物易受污染
E. 生熟交叉污染

正确答案：A。气温较高，微生物易于生长繁殖